患者喘息咳唾，胸背痛，短气，右脉沉迟，左脉弦急，治宜
A. 桂枝生姜枳实汤
B. 枳实薤白桂枝汤
C. 瓜蒌薤白半夏汤
D. 瓜蒌薤白白酒汤
E. 橘枳姜汤

正确答案：D。瓜蒌薤白白酒汤

解析：寸候上焦，寸口脉沉而迟为胸阳不振；关候中焦，关上小紧数，为寒饮内停、正邪交争之脉象。由于胸阳不振、肺失肃降，故喘息咳唾，短气；痰浊阻滞，胸阳不宣，心脉痹阻。故胸背痛。治宜通阳宣痹，用括楼薤白白酒汤治疗（D对）。方中括楼实苦寒滑利。豁痰宽胸；薤白辛温，通阳散结；白酒功善通阳，可助药势。诸药配伍，使痹阻得通，胸阳得宣，则诸症可解。